某男，34岁。体疫弱，患十二指肠溃疡2年。深秋时节，突遭寒风来袭，引发脘腹疼痛，并伴喜温喜按、嘈杂吞酸、食少。治当温中补虚、缓急止痛，宜选用的成药是
A. 良附丸
B. 四逆汤
C. 香砂平胃丸
D. 小建中合剂
E. 附子理中丸

正确答案：D。小建中合剂

解析：本题考查小建中合剂的功能。治当温中补虚、缓急止痛，宜选用的成药是小建中合剂（D对）。小建中合剂【功能】温中补虚，缓急止痛。【主治】脾胃虚寒所致的脘腹疼痛、喜温喜按、嘈杂吞酸、食少；胃及十二指肠溃疡见上述证候者。良附丸（A错）【功能】温胃理气。【主治】寒凝气滞，脘痛吐酸，胸腹胀满。四逆汤（B错）【功能】温中祛寒，回阳救逆。【主治】阳虚欲脱，冷汗自出，四肢厥逆，下利清谷，脉微欲绝。香砂平胃丸（C错）【功能】理气化湿，和胃止痛。【主治】湿浊中阻、脾胃不和所致的胃脘疼痛、胸膈满闷、恶心呕吐、纳呆食少。附子理中丸（E错）【功能】温中健脾。【主治】脾胃虚寒所致的脘腹冷痛、呕吐泄泻、手足不温。